正常体液中可以杀菌、抑菌物质的是
A. 补体
B. 胃酸
C. 溶菌酶
D. 乳酸
E. 以上均是

正确答案：E。以上均是

解析：本题考查宿主的抗菌免疫及感染的发生发展。正常体液中的杀菌、抑菌物质有补体（A对）、溶菌酶（C对）、胃酸（B对）、乳酸（D对）等。因此选E。